Meckel憩室
A. 位于空肠壁上的囊状突起
B. 为胚胎期卵黄囊管未消失而形成的囊状突起
C. 位于回肠末端壁上的囊状突起
D. 位于盲肠壁上的囊状突起
E. 无

正确答案：B。为胚胎期卵黄囊管未消失而形成的囊状突起

解析：Meckel憩室是位于回肠对系膜缘上的囊状突起(ACD错)，是胚胎期时卵黄囊管没完全消失形成的囊状突起(B对)。